女，55岁，高血压史多年。临床：牙龈边缘及牙龈乳头充血水肿，全口牙龈增生覆盖牙冠的1/3～1/2。此患者若诊断为药物性牙龈增生，哪一药物与之最密切
A. 大仑丁类
B. 环孢菌素
C. 硝苯吡啶
D. 消心痛
E. 利血平

正确答案：C。硝苯吡啶

解析：本题考查药物性牙龈肥大。与药物性牙龈增生有关的三类常用药物是：抗癫痫药、免疫抑制剂和钙通道阻滞剂。患者诊断为药物性龈增生，有高血压病史，则考虑是由服用常作为降压药的钙通道阻滞剂的药物引起的，选项中硝苯吡啶（C对）为钙通道阻滞剂，是常用的降压药。大仑丁类（A错）为抗癫痫药，是癫痫大发作的首选药。环孢菌素（B错）为免疫抑制剂，常用于器官移植或某些自身免疫性疾病患者。消心痛（D错）是长效硝酸酯类抗心绞痛药，用于缓解急性心绞痛发作。利血平（E错）是一种交感神经抑制药，适应症为高血压，但是不推荐为一线用药。